DNA分子上的碱基错配称为
A. 点突变
B. 插入
C. 缺失
D. 倒位
E. 移码突变

正确答案：A。点突变

解析：DNA分子上的碱基错配，称为点突变。点突变发生在基因编码区，可导致氨基酸的改变。镰形红细胞贫血患者的Hb基因中，编码第6号氨基酸的密码子上一个碱基发生点突变，引起Hb功能异常而致病。掌握“概述及DNA的生物合成”知识点。